血管紧张素转化酶抑制剂的禁忌症
A. 低钾血症
B. 痛风
C. 体位性低血压
D. 双侧肾动脉狭窄
E. 2-3度房室传导阻滞

正确答案：D。双侧肾动脉狭窄

解析：本题考查药物的禁忌症。血管紧张素转化酶抑制剂的禁忌症是双侧肾动脉狭窄（D对）。血管紧张素转换酶抑制剂（ACEI）禁用于双侧肾动脉狭窄、高钾血症及妊娠期。痛风（B错）为噻嗪类利尿剂禁忌症。体位性低血压（C错）为α受体阻断剂禁忌症。2-3度房室传导阻滞（E错）为非二氢吡啶类钙通道阻滞剂的禁忌症。